男，10岁。发热头痛呕吐3天，嗜睡半天，于7月10日入院。既往体健。查体T38.6℃，P112次/分，R20次/分，BP130/75mmHg。神志不清，皮肤未见出血点，心肺未见异常，腹软，压痛及反跳痛（-），肝脾肋下未触及，颈抵抗（+），双侧Babinski征（+）。实验室检查血WBC124×10⁹/L，中性粒细胞0.70，淋巴细胞0.30。腰穿脑脊液检查压力200mmH₂O，WBC170×10⁶/L，单核0.66，多核0.34，蛋白11g/L，糖42mmol/L，氯化物115mmol/L。最有助于确诊的检查是
A. 血清特异性IgM抗体
B. 脑脊液涂片找细菌
C. 脑脊液培养
D. 血培养
E. 结核菌素试验

正确答案：A。血清特异性IgM抗体

解析：10岁男性患儿，发热头痛呕吐3天，嗜睡半天（流行性乙型脑炎初期症状），于7月10日入院（流行性乙型脑炎夏秋季高发），既往体健，查体T38.6℃，P112次/分，R20次/分，BP130/75mmHg。神志不清，皮肤未见出血点，心肺未见异常，腹软，压痛及反跳痛（－），肝脾肋下未触及，颈抵抗（+），双侧Babinski征（+）（流行性乙型脑炎极期症状）。实验室检查血WBC124×10⁹/L（正常参考值4～10×10⁹/L），中性粒细胞0.70（正常参考值0.5～0.7），淋巴细胞0.30（正常值0.2～0.4）。腰穿脑脊液检查压力200mmH₂O（儿童脑压正常值40.8～102mmH₂O），WBC170×10⁶/L（儿童正常值0～15× 10⁶/L），单核0.66，多核0.34，蛋白11g/L（腰穿正常值0.2～0.45g/L），糖4.2mmol/L（腰池正常值2.5～4.5mmol/L），氯化物115mmol/L（腰池正常值120～130mmol/L），根据患者临床表现及实验室检查，该患者最可能的诊断为流行性乙型脑炎，临床上以高热、意识障碍、抽搐、病理反射及脑膜刺激征为特征，外周血白细胞总数增高，脑脊液压力增高，白细胞增多，蛋白轻度增高，糖正常或偏高，氯化物正常，血清特异性IgM抗体（A对）有助于早期确诊。乙脑为病毒性感染，不能通过细菌培养检查（BCD错），脑脊液培养和涂片用于诊断化脓性脑膜炎。结核菌素试验（E错）用于鉴定人体是否感染结核杆菌和感染反应程度（P216）。